可代替立克次体为抗原进行外斐反应的细菌是
A. 大肠埃希菌
B. 痢疾杆菌
C. 变形杆菌
D. 铜绿假单胞菌
E. 百日咳鲍特菌

正确答案：C。变形杆菌